小儿厌食的主要发病原因是
A. 喂养不当，纳运失健
B. 饮食不洁，脾胃受损
C. 过食肥甘，耗损津液
D. 乳食内积，郁而化热
E. 肝失疏泄，脾土受侮

正确答案：A。喂养不当，纳运失健

解析：小儿脏腑娇嫩，脾常不足，乳食不知自节，若家长缺乏育婴保健知识，喂养不当，损伤脾胃，脾胃运化能力失常，从而产生厌食（A对）。饮食不洁、过食辛辣、乳食内积均可使脾胃受损，但小儿所进食之物，均由父母喂养，厌食的根本原因为父母喂养的这一阶段的不当（BCD错）。小儿神气怯弱，易受惊恐，易致肝失调达，乘脾犯胃，形成厌食，但亦不是形成厌食的主要原因（E错）。